某研究者根据由世界粮农组织提供的129个国家的食品消耗种类数量以及由世界卫生组织提供的这129个国家的胃癌和乳腺癌死亡率的资料，以人均食物种类的消耗量为暴露变量，分别与胃癌和乳腺癌的死亡率进行比较分析。发现以淀粉类食物为主的国家，胃癌高发；而平均脂肪消耗量高的国家，则乳腺癌高发。该研究采用的流行病学设计属于
A. 现况研究
B. 生态趋势研究
C. 生态比较研究
D. 队列研究
E. 实验性研究

正确答案：C。生态比较研究